患者女，27岁。皮肤自发性紫癜发作3年，面色白，神疲乏力，腹胀食少，舌淡红苔薄白，脉细弱。治疗首选
A. 泻心汤
B. 犀角地黄汤
C. 归脾汤
D. 四物汤
E. 茜根散

正确答案：C。归脾汤

解析：患者为年轻女性，自发性紫癜反复发作3年，面色白，神疲乏力为气血不足的表现，又有腹胀食少脾气虚的表现，结合患者的舌苔脉象，舌淡红，苔薄白，脉细弱，可判断患者属于过敏性紫癜中医证型的气不摄血证，治宜健脾益气摄血，故治疗首选归脾汤（C对）。